藏象学说主要是研究
A. 脏腑生理
B. 脏腑病理
C. 脏腑生理病理之间的关系
D. 脏腑生理病理及其相互关系
E. 脏腑的组织器官结构形态

正确答案：D。脏腑生理病理及其相互关系

解析：该题考查中医学的藏象学说的内容。藏象学说，是研究人体脏腑生理功能、病理变化规律及相互关系的学说（D对）。